女，35岁，宫内节育器避孕10年，阴道不规则流血2个月，要求取环，妇科检查：外阴阴道充血，阴道少量流血，伴异味，宫颈光滑，子宫及双侧附件未触及异常，下列处理不正确的是
A. 需先治疗生殖道炎症
B. 血hCG检查排除妊娠
C. 取样同时建议刮宫
D. 需血止后3～7天取环
E. 取环前需盆腔超声检查

正确答案：D。需血止后3～7天取环

解析：患者中青年女性，宫内节育器避孕10年，阴道不规则流血2个月，妇科检查示外阴阴道充血，伴异味，提示生殖道感染，因此需先治疗生殖道炎症（A对）；患者不规则流血数月，取样同时建议刮宫（C对）以排除子宫内膜癌。常规还需要注意：行血hCG检查（B对）排除妊娠；行盆腔超声检查（E对）确定生育环位置等再进行取环。正常节育妇女可于经期止血后3～7天取环（D错，为本题正确答案）。